能疏肝和胃的中成药是
A. 养胃舒胶囊
B. 加味左金丸
C. 温胃舒胶囊
D. 香砂平胃丸
E. 开胃山楂丸

正确答案：B。加味左金丸